女，26岁。平素月经规律，停经45天。行人工流产术，术中见完整绒毛，术后至今已4周余，阴道仍淋漓出血。妇科检査：子宫饱满，少软，活动好。彩色B超检查：宫腔清晰，前壁肌层有局灶性丰富血流信号。为明确诊断首选的检査应是
A. 血hCG测定
B. 诊断性刮宫
C. 宫腔镜
D. 腹腔镜
E. 孕激素试验

正确答案：A。血hCG测定

解析：患者为年轻妇女，平素月经规律，停经45天。行人工流产术，术中见完整绒毛（说明患者为非葡萄胎妊娠及无恶变），术后至今已4周余，阴道仍淋漓出血（滋养细胞肿瘤表现为在葡萄胎排空、流产或足月产后，有持续的不规则阴道流血，量多少不定）。妇科检査：子宫饱满，稍软，活动好。彩色B超检查宫腔清晰，前壁肌层有局灶性丰富血流信号（彩色多普勒超声主要显示丰富的血流信号和低阻力型血流频谱），考虑为滋养细胞肿瘤，因患者为非葡萄胎妊娠，只能继发为绒毛膜癌。为明确诊断首选的检査应是血hCG测定（A对），hCG水平是妊娠滋养细胞肿瘤的主要诊断依据，足月产、流产和异位妊娠后hCG多在4周左右转为阴性，若超过4周血清hCG仍持续高水平，或一度下降后又上升，在除外妊娠物残留或再次妊娠后，可诊断妊娠滋养细胞肿瘤。组织病理学检查时，在子宫肌层内或子宫外转移灶组织中若见到绒毛或退化的绒毛阴影，则诊断为侵蚀性葡萄胎；若仅见成片滋养细胞浸润及坏死出血，未见绒毛结构者，则诊断为绒癌。而诊断性刮宫（P419）（B错）、宫腔镜（P445）（C错）只能刮取子宫内膜组织，不能用于子宫肌层组织或子宫外转移灶组织的活检，故不能用于滋养细胞肿瘤的确诊。腹腔镜（D错）虽能用于子宫外转移灶组织的活检，结合组织学检查可诊断妊娠滋养细胞肿瘤，但由于创伤大且易诱发转移，不作为首选的检查方法。孕激素试验（E错）多用于闭经原因的诊断，对妊娠滋养细胞肿瘤的确诊无意义。